术后腹气胀应选用以下哪种药
A. 阿托品
B. 东莨菪碱
C. 毒扁豆碱
D. 新斯的明
E. 毛果芸香碱

正确答案：D。新斯的明